神倦乏力，腰膝酸软
A. 肺气虚
B. 心气虚
C. 脾气虚
D. 肾气虚
E. 肺阴虚

正确答案：D。肾气虚

解析：本题考查的是肾气虚证的临床表现。神倦乏力，腰膝酸软多见于肾气虚（D对）。肾气虚证，症见腰膝酸软，头晕耳鸣，神疲乏力等。肺气虚（A错）证的临床表现，常见咳喘无力，气短懒言，声音低微，或语言断续无力，稍一用力则气吁而喘，周身乏力，自汗出，面色白，舌质淡嫩，脉虚弱等。心气虚（B错）证的临床表现：心阳虚与心气虚的共有症状是：心悸，气短，自汗，活动或劳累后加重。心气虚证的临床表现，除上述共有症状外，兼见面色白、体倦乏力、舌质淡、舌体胖嫩、苔白、脉虚。脾气虚（C错）证的临床表现：由于素体虚弱，劳倦与饮食不节等，内伤脾气，以致脾气虚弱。临床上常见脾虚证候可分三类：（1）脾失健运证：临床表现常见食纳减少，食后作胀，或肢体浮肿，小便不利，或大便溏泻，时息时发，并伴有身倦无力、气短懒言、面色萎黄、舌质淡嫩、苔白、脉缓弱。（2）脾虚下陷证：临床表现常见子宫脱垂，脱肛，胃下垂，慢性腹泻，并见食纳减少，食后作胀，少腹下坠，体倦少气，气短懒言，面色萎黄，舌淡苔白，脉虚。（3）脾不统血证：临床表现常见面色苍白或萎黄，饮食减少，倦怠无力，气短，肌衄，便血以及妇女月经过多，或崩漏，舌质淡，脉细弱。肺阴虚（E错）证的临床表现，常见咳嗽较重，干咳无痰，或痰少而黏，并有咽喉干痒，或声音嘶哑，身体消瘦，舌红少津，脉细无力。阴虚火旺还可见咳痰带血，干渴思饮，午后发热，盗汗，两颧发红，舌质红，脉细数。